全口义齿初戴时发现正中（牙合）正常，前伸（牙合）前牙接触，后牙不接触，应调磨何处为主
A. 上切牙切缘舌斜面
B. 上切牙切缘唇斜面
C. 上切牙舌窝
D. 下切牙唇斜面
E. 下切牙切缘舌斜面

正确答案：D。下切牙唇斜面

解析：前伸（牙合）干扰的选磨：前伸（牙合）后牙的（牙合）干扰发生在上颌后牙远中斜面与下颌后牙近中斜面，调磨应同时遵守BULL法则和DUML法则，即分别调磨上牙颊尖远中斜面和下牙舌尖近中斜面。对于前伸（牙合）干扰，应选磨下前牙的唇斜面或上前牙的舌斜面，避免磨短上前牙。掌握“全口义齿初戴”知识点。